影响核酸代谢的药物是
A. 麻黄碱
B. 维拉帕米
C. 氟尿嘧啶
D. 奥美拉唑
E. 去甲肾上腺素

正确答案：C。氟尿嘧啶

解析：本题考查影响核酸代谢的药物。影响核酸代谢的药物是氟尿嘧啶（C对）。影响核酸生物合成的药物又称抗代谢药，5-FU在细胞内经酶转变为5-氟尿嘧啶脱氧核苷酸（5F-dUMP）而竞争性抑制脱氧胸苷酸合成酶，阻止脱氧尿苷酸（dUMP）甲基化为脱氧胸苷酸（dTMP），从而影响DNA的合成。麻黄碱（A错）是影响神经递质储存和释放的药物。维拉帕米（B错）为钙通道阻滞剂。奥美拉唑（D错）为H⁺-K⁺-ATP酶抑制剂。去甲肾上腺素（E错）为α受体激动药。